供潜水员呼吸的空气压力需
A. 等于大气压
B. 高于大气压
C. 等于绝对压
D. 低于绝对压
E. 高于附加压

正确答案：C。等于绝对压